阿托品的药理作用包括
A. 升高眼内压
B. 减少腺体分泌
C. 缩瞳
D. 收缩血管
E. 松弛平滑肌

正确答案：A、B、E。升高眼内压；减少腺体分泌；松弛平滑肌